某女，65岁，时发水泻，历时3年就诊是正值盛暑，每日水泻3～4次，伴倦怠乏力，畏寒肢冷，舌质淡，苔白水滑，脉沉。医师诊为脾虚水湿不运之泄泻，处方为炒白术、茯苓、猪苓、炒泽泻、陈皮、炒车前子、炒山药，水煎服。服药5剂，水泻遂止，倦怠乏力、畏寒肢冷有所改善。医师在处方中选用炒白术，是因其既能健脾止泻，又能
A. 燥湿利水
B. 燥湿行气
C. 化湿行气
D. 胜湿止泻
E. 化湿止泻

正确答案：A。燥湿利水

解析：本题考查的是白术的功效。医师在处方中选用炒白术，是因其既能健脾止泻，又能燥湿利水（A对）。白术：【功效】补气健脾，燥湿利水，止汗，安胎。草豆蔻：【功效】燥湿行气（B错），温中止呕。砂仁：【功效】化湿行气（C错），温中止泻（E错），安胎。功效为胜湿止泻（D错）的中药，2022年考试指南未明确说明。